圆环形卡环通常包绕基牙的
A. 2个面和2个轴角
B. 2个面和3个轴角
C. 3个面和2个轴角
D. 3个面和3个轴角
E. 3个面和4个轴角

正确答案：E。3个面和4个轴角

解析：圆环卡环常包绕基牙的3个轴面和4个轴面角，即包绕基牙牙冠的3/4以上，好似圆圈，故名圆环卡环，这种卡环为Aker（1936）首先应用，故又称Aker卡环。此类卡环适用于健康的、牙冠外形好的基牙上，牙支持式可摘局部义齿最常用，固位、支持和稳定作用均好。掌握“局部义齿固位体”知识点。